适用于错位牙、扭转牙而非正畸治疗适应证者的
A. 嵌体
B. 部分冠
C. 桩核冠
D. 塑料全冠
E. 铸造金属全冠

正确答案：C。桩核冠

解析：本题考查牙体缺损修复体固位及适应、禁忌证。桩核冠（C对）适应证：①牙冠大部分缺损无法充填治疗或做全冠修复固位不良者。②牙冠缺损至龈下，牙周健康，牙根有足够的长度，经牙冠延长术或正畸牵引术后能暴露出断面以下最少1.5mm的根面高度，磨牙以不暴露根分叉为限。③错位牙、扭转牙而非正畸治疗适应证者。④畸形牙直接冠修复预备固位形不良者。